慢性化脓性唾液腺炎多发生于唾液腺哪个部位
A. 腮腺和舌下腺
B. 腮腺和下颌下腺
C. 舌下腺和下颌下腺
D. 舌下腺和唇腺
E. 唇腺和腭腺

正确答案：B。腮腺和下颌下腺

解析：慢性唾液腺炎以慢性化脓性唾液腺炎多见，多发生于下颌下腺及腮腺。掌握“慢性唾液腺炎的病理变化”知识点。